某药的消除符合一级动力学，其t½为4小时，在定时定量给药后，需经多少小时才能达到稳态血药浓度
A. 约10小时
B. 约20小时
C. 约30小时
D. 约40小时
E. 约50小时

正确答案：B。约20小时